随着疾病谱、死因谱的改变，慢性病成为威胁人们健康的主要疾病，防治慢性病，必须重视
A. 医院服务
B. 专科服务
C. 临床服务
D. 预防服务
E. 社区卫生服务

正确答案：E。社区卫生服务